下列关于急性粟粒型肺结核X线描述，错误的是
A. 密度均匀
B. 分布均匀
C. 大小均匀
D. 可见局部钙化
E. 阴影边界清晰

正确答案：D。可见局部钙化

解析：急性粟粒型肺结核X线检查早期常呈阴性，起病1～2周后可见大小均匀（C对）分布均匀（B对）、密度均匀（A对）的粟粒状阴影（三均匀的粟粒状阴影），密布于两侧肺野，阴影边界清晰（E对）或仅有弥散性网状结构阴影，病变急剧进展可形成空洞、肺气肿、肺大泡、自发性气胸，经合理化疗，病灶可于2～10周后开始吸收，6～7个月完全消失。可见局部钙化（D错，为本题正确答案）为慢性粟粒型肺结核的X线表现，为病变部位长期存在，病变部位发生钙化。